女性，26岁，10天来全身皮肤出血点伴牙龈出血来诊。实验室检查：PLT35×109/L，临床诊断为慢性特发性血小板减少性紫癜（ITP）下列体征支持ITP诊断的是
A. 皮肤有略高出皮面的紫癜
B. 面部蝶形红斑
C. 口腔溃疡
D. 下肢肌肉血肿
E. 脾脏不大

正确答案：E。脾脏不大

解析：过敏性紫癜可出现皮肤有略高出皮面的紫癜。蝶形红斑是见于系统性红斑狼疮患者两侧面颊对称性的面部红斑，通过鼻梁相连，颜色有淡红色或是鲜红色，如一只蝴蝶覆之，故称为蝶形红斑，是系统性红斑狼疮中特异性较高的一种皮损。口腔溃疡、下肢肌肉血肿不伴发血小板异常。特发性血小板减少性紫癜脾脏一般不大或轻度肿大。掌握“特发性血小板减少性紫癜（ITP）”知识点。